男，35岁，会阴部骑跨伤，受伤后尿道外口滴血，伴尿时疼痛加重，会阴部和阴囊处轻度肿胀，瘀斑。首选的处理方法是
A. 单纯血肿清除
B. 膀胱造瘘
C. 试插导尿管引流尿液+抗感染治疗
D. 尿道会师复位
E. 尿道段端吻合

正确答案：C。试插导尿管引流尿液+抗感染治疗

解析：青年男性患者，会阴部骑跨伤（提示可能有前尿道损伤）后尿道外口滴血，伴尿时疼痛加重，会阴部和阴囊处轻度肿胀、瘀斑（前尿道损伤典型表现），结合患者病史和临床表现，考虑该患者泌尿系损伤的部位是前尿道损伤，最多见于尿道球部。首选的处理方法应为试插导尿管引流尿液，借以判断有无尿道断裂并起支撑尿道的作用，同时应用抗生素预防感染（C对）。患者会阴部和阴囊处仅有轻度肿胀、瘀斑，无需行血肿清除（A错）。膀胱造瘘（B错）和尿道断端吻合术（E错）主要用于尿道断裂、症状较重的患者。尿道会师复位（D错）主要用于后尿道损伤时的治疗。